可用维生素K₁解救的是
A. 阿片类药物中毒
B. 克伦特罗（瘦肉精）中毒
C. 有机磷中毒
D. 华法林所致中毒
E. 甲基苯丙胺（冰毒）中毒

正确答案：D。华法林所致中毒

解析：本题考查香豆素类杀鼠药中毒的解救。香豆素类杀鼠药（如华法林）（D对）特效解毒剂：静脉滴注维生素K₁10～30mg，一日1～3次；亦可先静脉注射维生素K₁50mg，然后改为10～20mg肌内注射，一日1～4次。严重出血时每日总量可用至300mg。